咳嗽，咳脓痰，咯血10年，近期发热、症状加重。痰培养查出铜绿假单胞菌，首选什么药
A. 头孢呋辛
B. 哌拉西林/他唑巴坦
C. 阿奇霉素
D. 罗红霉素
E. 诺氟沙星

正确答案：B。哌拉西林/他唑巴坦

解析：对于存在铜绿假单胞可选择具有抗假单胞菌活性的β-内酰胺类抗生素（如头孢他啶、头孢吡肟、哌拉西林／他唑巴坦、头孢哌酮／舒巴坦），碳青霉烯类（如亚胺培南、美罗培南），氨基糖苷类，喹诺酮类（环丙沙星或左氧氟沙星），可单独应用或联合应用（B对）。